人体对邻苯二甲酸酯的主要暴露方式为
A. 饮用水
B. 呼吸
C. 食物摄入
D. 皮肤接触
E. 输液接触

正确答案：C。食物摄入

解析：本题考查邻苯二甲酸酯的相关内容。邻苯二甲酸酯（C对）又称酞酸酯（PAE）是广泛使用的化工原料和化工产品。环境中的PAE可经呼吸、消化道和皮肤接触进入人体。但人类暴露PAE的主要方式是通过食物摄入（C对ABDE错），经饮水和呼吸暴露远低于食物。